关于胸膜隐窝的叙述，下列哪项是错误的
A. 深吸气时肺缘不能充满的胸膜腔，称胸膜隐窝
B. 有肋纵隔隐窝
C. 有肋膈隐窝
D. 有肺胸膜隐窝
E. 肋膈隐窝的位置最低

正确答案：D。有肺胸膜隐窝

解析：深吸气时肺缘不能充满的胸膜腔，称胸膜隐窝（A对）。胸膜隐窝包括肋膈隐窝（C对）、肋纵隔隐窝（B对）和膈纵隔隐窝等（D错、为本题正确答案）。肋膈隐窝的位置最低（E对）。